描述不属于新生儿黄疸寒湿阻滞证候特征的是
A. 四肢欠温
B. 舌淡苔白腻
C. 黄色鲜明
D. 目黄身黄
E. 神疲倦怠

正确答案：C。黄色鲜明

解析：寒湿阻滞证为阴黄，黄色色泽晦暗（C错，为本题正确答案）。其证候为面目皮肤发黄（D对），色泽晦暗（C错，为本题正确答案），黄疸持久不退，精神倦怠（E对），四肢欠温（A对），不欲吮乳，时时啼哭，大便溏薄，或便色灰白，小便短少，舌质偏淡，舌苔白腻（B对）。